完全抗原
A. 只有免疫原性，无免疫反应性
B. 只有免疫反应性，无免疫原性
C. 既无免疫原性，又无免疫反应性
D. 既有免疫原性，又有免疫反应性
E. 不能激发细胞免疫应答

正确答案：D。既有免疫原性，又有免疫反应性

解析：抗原是指能与T细胞、B细胞的表面受体结合，促使其增值、分化，产生抗体或致敏淋巴细胞，并与之结合，进而发挥免疫效应的物质（E错）。将同时具有免疫原性和免疫反应性的物质称免疫原（D对AC错），又称完全抗原。无免疫原性，仅具备免疫反应性的物质（B错）（P20），称为不完全抗原，又称半抗原。